对口腔颌面部损伤患者进行包扎的作用不包括
A. 防止或减轻水肿
B. 暂时性固定，使骨折端减少活动，防止进一步移位
C. 压迫止血
D. 保护术区和创口
E. 可以避免血液及其他分泌物打湿敷料

正确答案：E。可以避免血液及其他分泌物打湿敷料

解析：本题考查绷带包扎的作用。对口腔颌面部损伤患者进行包扎的作用不包括可以避免血液及其他分泌物打湿敷料（E错，为本题正确答案）。敷料是指盖在患者受伤的部位上，协助控制出血症状、防治感染、并可以吸收一些伤口部位的分泌物、有保护作用的覆盖物。绷带包扎的作用有：1.保护术区和创口（D对），防止污染或继发感染，避免再度受损。2.保温、压迫止血（C对），并防止或减轻水肿（A对）、疼痛。3.暂时性固定，使骨折端减少活动，防止进一步移位（B对）。4.固定敷料，防止敷料脱落或移位。